残根是指
A. 遗留牙槽窝中时间较久的牙根
B. 拔牙术中折断的牙根，拔除较为复杂
C. 牙齿由于龋坏等原因而致使牙冠的大部分缺损
D. 由于邻牙、骨或软组织的阻碍而只能部分萌出或完全不能萌出，且以后也不可能萌出的牙
E. 牙冠外层的白色半透明的钙化程度最高的坚硬组织

正确答案：A。遗留牙槽窝中时间较久的牙根

解析：遗留牙槽窝中时间较久的牙根为残根。在根尖周和牙槽骨壁间，多存在慢性炎症及肉芽组织，根尖、牙周膜及牙槽骨壁均有程度不等的吸收。掌握“牙根拔除术”知识点。